酚妥拉明临床应用除外的是
A. 治疗外周血管痉挛性疾病
B. 去甲肾上腺素滴注外漏
C. 肾上腺嗜铬细胞瘤
D. 心律失常
E. 药物引起的高血压

正确答案：D。心律失常

解析：酚妥拉明临床应用：①治疗外周血管痉挛性疾病；②去甲肾上腺素滴注外漏；③肾上腺嗜铬细胞瘤；④抗休克；⑤治疗急性心肌梗死和顽固性充血性心力衰竭；⑥药物引起的高血压。掌握“α肾上腺素受体阻断剂”知识点。